处方一般当日有效。特殊情况下有效期可延长，但最长不得超过
A. 2天
B. 3天
C. 5天
D. 7天
E. 10天

正确答案：B。3天

解析：本题考查的是处方审核的原则和要求。调剂处方一般以当日有效，特殊情况下有效期可延长，但最长不得超过3天（B对）。在审方中必须注意以下几点。1.认真审查处方各项内容，包括处方前记、正文、后记是否清晰完整，并确认处方的合法性，对不规范处方或不能判定其合法性的处方不得调剂。对老年、妊娠期、儿童、肝肾功能异常等特殊人群的用药适宜性进行重点审核，如发现问题，应向处方医生或患者核对。2.药师审核处方后，认为存在用药不适宜时，如有用药不对证、妊娠禁忌、配伍禁忌、超剂量用药、超时间用药、服用方法有误、毒麻药使用违反规定等，应当告知处方医师，请其确认或者重新开具处方。3.药师发现严重不合理用药或者用药错误，应当拒绝调剂，及时告知处方医师，并应当记录，按照有关规定报告。4.处方一般当日有效，特殊情况下需延长有效期的，由开具处方的医师注明有效期，但最长不得超过3天。5.药师不应擅自涂改医师处方所列的药味、剂量、处方旁注等。